毛果芸香碱用于眼科治疗虹膜炎的目的是
A. 消除炎症
B. 防止穿孔
C. 防止虹膜与晶体的粘连
D. 促进虹膜损伤的愈合
E. 抗微生物感染

正确答案：C。防止虹膜与晶体的粘连